根据药品管理法律法规及相关文件的规定，不得零售的是
A. 血液制品
B. 第二类精神药品
C. 含麻黄碱类复方制剂
D. 第一类精神药品

正确答案：D。第一类精神药品

解析：本题考查特殊药品的零售管理。根据药品管理法律法规及相关文件的规定，不得零售的是第一类精神药品（D对）。麻醉药品和第一类精神药品不得零售。除经批准的药品零售连锁企业外，其他药品零售企业不得从事第二类精神药品零售活动。第二类精神药品一般每张处方不得超过7日常用量（B错）。血液制品（A错）不属于药品零售企业经营范围。药品零售企业销售含麻黄碱类复方制剂（C错），应当查验购买者的身份证，并对其姓名和身份证号码予以登记。